我国各级药品监督管理部门是药品监督管理行政执法机关，行政执法的主要中心任务是
A. 对药品价格实施宏观管理
B. 对药品广告进行综合监督管理
C. 实施国家医药储备
D. 宏观规划管理医药经济发展
E. 保证人民用药安全、有效

正确答案：E。保证人民用药安全、有效